在医院中，所有医务人员的一切诊疗活动，都以救死扶伤、防病治病，为人民的健康服务为宗旨，需要服从协调，说明医务人员之间的关系具有
A. 协作性
B. 同一性
C. 平等性
D. 合作性
E. 竞争性

正确答案：B。同一性

解析：在医院中，所有医务人员的一切诊疗活动，都以救死扶伤、防病治病，为人民的健康服务为宗旨，需要服从协调，说明医务人员之间的关系具有同一性（B对）。协作性（A错）是指在现代医学高度分化与高度综合的背景下，患者的诊治往往需要诸多科室的医务人员共同参与和配合，如一台手术，除了医师，还有护士、麻醉师、化验员、药剂人员等多方人员共同努力才能完成，缺少其中的任何一方，患者都难以恢复健康。平等性（C错）指的是护士、医（药）技人员不能只处于服从的、被支配的地位。事实上，如果其他医务人员发现医师的诊治方案中存在不适当的问题，有权建议或要求其进行修改或变更。现实的医疗活动需要各个学科之间、不同的专业人员之间密切配合，相互支持，优势互补，只有这样才能发挥医疗团队的整体合力。竞争性（E错）是指现代医学技术的飞速发展，要求所有的医务人员都不能满足于已有的知识和技术，要不断地学习知识、完善技术，只有在比、学、赶、帮、超的人际关系环境中，才能保持知识和技术上的先进性，否则就会跟不上与他人协作的步迈，就会被时代所淘汰。